神经源性肿瘤多见于
A. 前纵膈
B. 后纵膈
C. 上纵膈
D. 下纵膈
E. 中纵膈

正确答案：B。后纵膈

解析：神经源性肿瘤多见于后纵膈（B对），畸胎瘤和皮样囊肿多发生于前纵膈。胸腺瘤多见于前上纵膈。